霍乱的典型临床表现是
A. 先泻后吐
B. 先吐后泻
C. 只泻不吐
D. 腹泻伴发热
E. 腹泻伴腹痛

正确答案：A。先泻后吐

解析：霍乱泻吐期的典型临床表现是先泻后吐（A对BC错），一般不伴有发热（D错）（O139型除外）。无痛性腹泻（E错）是发病的第一个症状，亦无里急后重。